关于药物经皮吸收及其影响因素的说法，错误的是
A. 药物在皮肤内蓄积作用有利于皮肤疾病的治疗
B. 汗液可使角质层水化从而增大角质层渗透性
C. 真皮给药只能发挥局部治疗作用
D. 真皮上部存在毛细血管系统，药物到达真皮即可很快地被吸收
E. 药物经皮肤附属器的吸收不是经皮吸收的主要途径

正确答案：C。真皮给药只能发挥局部治疗作用

解析：本题考查药物经皮吸收。皮肤给药常用于皮肤疾患的治疗或起保护皮肤的作用，当药物治疗剂量小，经皮渗透速度大时，有可能产生全身治疗作用或副作用（C错，为本题正确答案）；药物在皮肤内产生蓄积有利于皮肤疾病的治疗（A对）；汗液可使角质层水化，水化的角质层密度降低，渗透性变大（B对）；真皮的上部存在毛细血管系统，药物渗透到达真皮会很快地被吸收（D对）；药物经皮吸收的主要途径是表皮途径，皮肤附属器仅占皮肤表面积的0.1%，不是药物经皮吸收的主要途径（E对）。